若无禁忌，冠心病或缺血性脑卒中患者均应长期使用的药物是
A. 氯吡格雷
B. 阿司匹林
C. 依诺肝素
D. 肝素
E. 达比加群酯

正确答案：B。阿司匹林

解析：本题考查阿司匹林。若无禁忌，冠心病或缺血性脑卒中患者均应长期使用的药物是阿司匹林（B对）。阿司匹林是抗血小板药的代表药，对所有发生急性缺血性心血管事件的患者，如心肌梗死、不稳定型心绞痛、缺血性脑卒中、一过性脑缺血发作等，若无禁忌，应尽快给予阿司匹林，长期服用。氯吡格雷（A错）用于近期心肌梗死（从几天到小于35天）、近期缺血性卒中（从7天到小于6个月）或确诊外周动脉性疾病及急性冠脉综合征，非ST段抬高性急性冠脉综合征（包括不稳定性心绞痛或非Q波心肌梗死）。依诺肝素（C错）预防深静脉血栓形成及肺栓塞，治疗已形成的静脉血栓。肝素（D错）用于防治血栓形成或栓塞性疾病、各种原因引起的弥漫性血管内凝血。达比加群酯（E错）是直接凝血酶抑制剂。